含氟漱口液5～6岁儿童每次用
A. 1ml
B. 5ml
C. 10ml
D. 15ml
E. 20ml

正确答案：B。5ml

解析：含氟漱口液的使用方法：使用漱口水时，根据儿童的年龄，用量筒或注射器取5ml或10ml配好的溶液于漱口杯中，5～6岁儿童每次用5ml，6岁以上儿童每次用10ml，嘱儿童将溶液含入口中，鼓漱1分钟后吐出，半小时内不进食或漱口。掌握“氟的全身及局部应用”知识点。